膜剂中不需加入的附加剂是
A. 着色剂
B. 增塑剂
C. 填充剂
D. 絮凝剂
E. 脱模剂

正确答案：D。絮凝剂

解析：本题考查膜剂的附加剂。膜剂中不需加入的附加剂是絮凝剂（D错，为本题正确答案）。膜剂的一般组成：主药0～70%（W/W）、成膜材料（PVA等）30%～100% 、增塑剂（B对）（甘油、山梨醇等）0～20% 、表面活性剂（聚山梨酯80 、十二烷基硫酸钠、豆磷脂等）1%～2% 、填充剂（C对）（CaC0₃、淀粉）0～20% 、着色剂（A对）（色素、TiO₂等）0～2%（W/W）、脱膜剂（E对）（液体石蜡）适量。